不回流到上腔静脉系的是
A. 奇静脉
B. 半奇静脉
C. 副半奇静脉
D. 左锁骨下静脉
E. 肺静脉

正确答案：E。肺静脉

解析：全身的静脉分为肺循环的静脉和体循环的静脉，肺静脉为肺循环的静脉，上腔静脉系为体循环的静脉，故肺静脉（E错，为本题正确答案）不回流到上腔静脉系。